男，70岁，咳嗽咳痰伴痰中带血1月，发热1周，吸烟40年，20支/天，有杵状指，X线可见右肺门阴影，为明确诊断可选择
A. 肿瘤标志物
B. 痰培养+药敏
C. 经皮穿刺活检
D. 增强CT
E. 痰找结核杆菌

正确答案：D。增强CT

解析：该患者男（肺癌多见于男性），70岁，吸烟40年，20支/天(肺癌的病因)，咳嗽咳痰伴痰中带血1月，发热1周，有杵状指（肺癌的表现），X线可见右肺门阴影（肺癌的X线表现），结合患者的年龄，病因，表现和辅助检查，行增强CT明确诊断（D对）。（P81）经胸壁穿刺肺活检：在X线透视、胸部或超声引导下可进行病灶针吸或切割活检。创伤小操作简便，可迅速获得结果，适用于紧贴胸壁或离胸壁较近的肺内病灶（C错）。（P82）迄今尚无诊断敏感性和特异性高的肿瘤标志物。癌胚抗原(CEA)、神经特异性烯醇酶(NSE)细胞角蛋白19片段(CYFRA2)和胃泌素释放肽前体(ProGRP)检测或联合检测时，对肺癌的诊断和病情的监测有一定参考价值（A错）。（P38）微生物学检查：应留取合格的痰标本送检涂片染色以及痰细菌培养，痰培养和药敏试验结果可指导抗菌药物的选择，痰液中找到抗酸杆菌时需要进一步分型是结核杆菌还是非结核分枝杆菌（BE错）。